面神经出茎乳孔后分成5支，分别是
A. 眼神经、上颌神经、下颌神经、颊神经、颈神经
B. 眼神经、耳颞神经、下颌神经、颊神经、颈神经
C. 眼神经、上颌支、下颌支、下颌缘支、颈支
D. 颞支、颧支、颊支、下颌缘支、颈支
E. 颞支、颧支、下颌缘支、颊支、舌下支

正确答案：D。颞支、颧支、颊支、下颌缘支、颈支

解析：面神经出茎乳孔后，在距皮肤表面2～3cm向前外，并稍向下经外耳道软骨和二腹肌后腹之间，在腮腺覆盖下，经茎突根部的浅面，进入腮腺，形成五组分支，由上至下依次为：颞支、颧支、颊支、下颌缘支、颈支。掌握“面神经、舌咽神经、舌下神经的分支与分布”知识点。